常用的身体素质指标是
A. 身高、体重、坐高、胸围
B. 血红蛋白、红细胞、血清铁
C. 握力、拉力、臂肌力
D. 中距离耐力跑、仰卧起坐、引体向上
E. 智力测验、记忆测验、人格测验

正确答案：D。中距离耐力跑、仰卧起坐、引体向上